脏腑关系中，被称为“燥湿相济”的是
A. 肺与大肠
B. 肾与膀胱
C. 心与肾
D. 肺与肝
E. 脾与胃

正确答案：E。脾与胃

解析：本题考查脾与胃的关系，属于理解记忆内容。脾与胃相对而言，脾为阴脏，以阳气温煦推动用事，脾阳健则能运化升清，故性喜燥而恶湿；胃为阳腑，以阴气凉润通降用事，胃阴足则能受纳腐熟，故性喜润而恶燥，故被称为“燥湿相济”的是脾与胃（E对）。肺与大肠的生理联系，主要体现在肺气肃降与大肠传导功能之间的相互为用关系（A错）。肾与膀胱的关系，主要表现在共主小便方面（B错）。心与肾在生理上的联系，主要表现为“心肾相交”（C错）。肺与肝的生理联系，主要体现在人体气机升降的调节方面（D错）。